病原微生物耐药性发生的机制
A. 形成针对特定抗菌药物的钝化酶或灭活酶
B. 细菌细胞壁通透性改变，使抗菌药物无法进入细胞内
C. 细菌细胞膜上存在的药物外排系统，使菌体内药物减少
D. 细菌靶位组成部位的变化，使抗菌药物不能与原作用靶点结合起效
E. 经质粒介导的耐药性在自然界最为多见

正确答案：A、B、C、D、E。形成针对特定抗菌药物的钝化酶或灭活酶；细菌细胞壁通透性改变，使抗菌药物无法进入细胞内；细菌细胞膜上存在的药物外排系统，使菌体内药物减少；细菌靶位组成部位的变化，使抗菌药物不能与原作用靶点结合起效；经质粒介导的耐药性在自然界最为多见

解析：本题考查病原微生物的耐药机制。耐药性的发生机制：①钝化酶或灭活酶（如β-内酰胺酶、氨基糖苷类钝化酶、氯霉素乙酰转移酶）的形成（A对）；②细菌细胞壁通透性改变，使抗生素无法进入细胞内（B对），从而难以作用于靶位；③细菌细胞膜上存在的抗感染药物外排系统，使菌体内药物减少（C对）而导致细菌耐药；④靶位组成部位的改变，使抗生素不能与靶位结合（D对）而发生抗菌效能。耐药性质粒广泛存在于革兰阳性菌和阴性菌中，经质粒介导的耐药性在自然界中最为多见（E对）。